可用于分离非极性物质的非极性吸附剂是
A. 凝胶
B. 硅藻土
C. 硅胶
D. 活性炭
E. 三氧化二铝

正确答案：D。活性炭

解析：本题考查的是活性炭吸附色谱法。可用于分离非极性物质的非极性吸附剂是活性炭（D对）。活性炭是非极性吸附剂，与硅胶、氧化铝相反，对非极性物质具有较强的亲和能力，在水中对溶质表现出强的吸附能力。溶剂极性降低，则活性炭对溶质的吸附能力也随之降低。故从活性炭上洗脱被吸附物质时，洗脱溶剂的洗脱能力将随溶剂极性的降低而增强。凝胶（A错）为是凝胶色谱法的填充剂。凝胶色谱法：凝胶色谱法也称凝胶过滤法、凝胶渗透色谱法、分子筛过滤或排阻色谱，是根据物质分子大小差别进行分离。硅藻土（B错）与活性炭合用也可通过吸附除去注射剂的热原。硅胶（C错）为物理吸附剂，分离原理都是根据吸附能力大小不同进行分离。三氧化二铝（E错）即氧化铝，氧化铝为吸附剂，分离原理都是根据吸附能力大小不同进行分离。另外，氧化铝又分为酸性或碱性氧化铝，如黄酮等酚酸性物质被碱性氧化铝的吸附，或生物碱被酸性氧化铝的吸附等，这又属于化学吸附。